不属于青霉素G不良反应的是
A. 过敏性休克
B. 荨麻疹
C. 用药局部红肿
D. 赫氏反应
E. 听力减退

正确答案：E。听力减退

解析：听力减退（E错，为本题正确答案）为氨基糖苷类抗生素的主要不良反应，不属于青霉素G不良反应。青霉素的常见不良反应包括变态反应（溶血性贫血、荨麻疹（B对）、接触性皮炎、间质性肾炎、过敏性休克（A对）等）、赫氏反应（D对）和其他不良反应（主要由局部疼痛、红肿（C对）和硬结）。